气管切开术常在何处进行？
A. 第1~4气管软骨环处
B. 第2~3气管软骨环处
C. 第3~5气管软骨环处
D. 第5~7气管软骨环处
E. 无

正确答案：C。第3~5气管软骨环处

解析：气管切开术常在第3-5气管软骨环处（C对）施行。